不是关于饮用水卫生监督的立法依据的是
A. 《生活饮用水卫生监督管理办法》
B. 《生活饮用水卫生标准》（GB 5749—2006）
C. 《中华人民共和国传染病防治法》
D. 《地表水环境质量标准》（GB 3838-2002）
E. 《二次供水设施卫生规范》

正确答案：D。《地表水环境质量标准》（GB 3838-2002）

解析：本题考查饮用水卫生监督的立法依据。关于饮用水卫生监督的立法依据有：《生活饮用水卫生监督管理办法》（A对），《生活饮用水卫生标准》（GB 5749-2006）（B对），《中华人民共和国传染病防治法》（C对）、《突发公共卫生事件应急条例》、《二次供水设施卫生规范》（E对）等。《地表水环境质量标准》（GB 3838-2002）（D错，为本题正确答案）不是关于饮用水卫生监督的立法依据。